5岁男孩。右侧阴囊包块，卧位不消失，右睾丸未扪及，透光试验阳性，正确诊断是
A. 右侧斜疝
B. 精索鞘膜积液
C. 交通性鞘膜积液
D. 右睾丸鞘膜积液
E. 右侧隐睾

正确答案：D。右睾丸鞘膜积液

解析：小儿患者右侧阴囊肿块，卧位肿块不消失，透光试验阳性，应诊断为右睾丸鞘膜积液（D对）。斜疝的疝囊进入阴囊时可有阴囊肿大，但透光试验阴性（A错）。精索鞘膜积液（B错）又称精索囊肿，其肿块多位于腹股沟或睾丸上方，查体睾丸可触及。交通性鞘膜积液（C错），立位时阴囊肿大，卧位时包块缩小或消失，睾丸可触及。隐睾（P522）（E错）指睾丸下降异常，使睾丸不能降至阴囊而停留在腹膜后、腹股沟管或阴囊入口处，主要表现为患侧阴囊小，触诊时不能触及睾丸。